女性，25岁。既往无精神病史，听闻其母急性心肌梗死去世后，患者不认识家人，反复念叨：不可能，你们骗我。此病人目前的急诊处理措施是
A. 予以地西泮10mg镇静
B. 予以氯丙嗪l00mg镇静
C. 予以支持性心理治疗
D. 暗示治疗
E. 碳酸锂治疗

正确答案：A。予以地西泮10mg镇静

解析：该病患女性，既往无精神病史，其母急性心肌梗死去世后（严重精神刺激），患者不认识家人，反复念叨：不可能，你们骗我（强烈恐惧体验的精神运动性兴奋），最可能的诊断是急性应激障碍（ASD）。本例目前的急诊处理措施是应予以地西泮镇静（A对）。暗示治疗主要用于癔症（分离（转换）障碍）（D错）。碳酸锂是最常见的心境稳定剂（抗躁狂药物），主要用于躁狂发作（E错）。